某边远医院收治一名宫外孕破裂失血性休克的患者，需紧急输血。需要注意的是
A. 向上级医院申请血源
B. 生命第一，可以不考虑血液安全
C. 收集家属血液
D. 临时釆集血液，并确保釆血用血安全
E. 等待安全血液，暂不处理

正确答案：D。临时釆集血液，并确保釆血用血安全

解析：根据《医疗机构临床用血管理办法》规定，为保证应急用血，医疗机构可以临时采集血液，但必须同时符合以下条件：①危及患者生命，急需输血；②所在地血站无法及时提供血液，且无法及时从其他医疗机构调剂血液，而其他医疗措施不能替代输血治疗。该患者宫外孕破裂失血性休克，危及患者生命，需紧急输血而其他医疗措施不能替代输血治疗。同时该医院为“边远医院”，说明此医院无法及时从所在地血站取血或者其他医疗机构调剂血液，情况紧急。根据《献血法》规定，为保证应急用血，该医院可以临时采集血液，并确保采血安全（D对B错）。因为患者情况紧急，且该医院地处边远，来不及采取以下措施：向上级医院申请血源（A错）、收集家属血液（C错）或者等待安全血液，暂不处理（E错）。